桑菊饮与桑杏汤中均含有的药物是
A. 杏仁
B. 桔梗
C. 象贝
D. 连翘
E. 苇根

正确答案：A。杏仁

解析：该题考查桑菊饮与桑杏汤的组成，属记忆内容。桑菊饮功能疏风清热，宣肺止咳，由桑叶、菊花、杏仁、连翘、薄荷、苦桔梗、生甘草、苇根。桑杏汤功能清宣温热，润肺止咳，由桑叶、杏仁、沙参、象贝、香豉、栀皮、梨皮（A对BCDE错）。记忆：趣记，桑菊饮，桑甘河人据苇根接桥。桑杏汤，桑杏、沙贝吃栀皮。